肝中较丰富的LDH同工酶是
A. LDH1
B. LDH2
C. LDH3
D. LDH4
E. LDH5

正确答案：E。LDH5

解析：乳酸脱氢酶（LDH）的同工酶在各组织中有不同的分布，心肌中较丰富的是LDH1（A错）；肝中较丰富是LDH5（E对）。